邻面龋常开始于
A. 接触点
B. 接触点（牙合）侧
C. 牙龈游离龈下
D. 接触点龈侧

正确答案：D。接触点龈侧

解析：本题考查邻面龋。接触点龈侧间隙狭小，食物软垢易在此聚集，不易清洁，容易导致菌斑牙石在此处附着，继而引起邻面龋损，邻面龋常开始于此处（D对）。牙龈游离龈下菌斑常引起根面龋而不是邻面龋（C错）。